又可称为“后韧带”的是
A. 颞下颌韧带
B. 翼下颌韧带
C. 蝶下颌韧带
D. 茎突下颌韧带
E. 茎突舌骨韧带

正确答案：D。茎突下颌韧带

解析：茎突下颌韧带：又称后韧带，起于茎突，向前下止于下颌角和下颌支后缘，可限制下颌过度前伸。掌握“颞下颌关节的解剖特点”知识点。